下列可以造成可摘局部义齿修复后食物嵌塞的原因中，除外
A. 义齿与组织之间出现缝隙
B. 卡环过紧，基托紧贴牙面
C. 基托与天然牙之间有间隙
D. 卡环与基牙不贴合
E. 原有基托与组织不密贴

正确答案：B。卡环过紧，基托紧贴牙面

解析：义齿与组织之间出现嵌塞和滞留食物，原有基托与组织不密贴，卡环与基牙不贴合，基托与天然牙之间有间隙，均可造成食物嵌塞。掌握“局部义齿修复后出现的问题及处理”知识点。